急性肾衰竭少尿期最常见的酸碱失衡是
A. 代谢性酸中毒
B. 呼吸性酸中毒
C. 代谢性碱中毒
D. 呼吸性碱中毒
E. 呼吸性酸中毒合并代谢性碱中毒

正确答案：A。代谢性酸中毒

解析：急性肾衰竭少尿期（维持期）常常伴代谢性酸中毒（A对），主要因为肾排酸能力减低，同时又因合并高分解代谢状态，使酸性产物明显增多。呼吸性酸中毒（B错）、呼吸性酸中毒合并代谢性碱中毒（E错）见于肺部病变、胸廓、胸膜腔病变或呼吸道阻塞等。代谢性碱中毒（C错）见于呕吐、长期胃肠吸引术、幽门梗阻等损失大量胃液后，也可由缺钾引起。呼吸性碱中毒（D错）见于癔症、严重贫血、心力衰竭、高热、使用呼吸兴奋药物等过度通气。